又名腺淋巴瘤的是
A. 混合瘤
B. 沃辛瘤
C. 腺样囊性癌
D. 腺泡细胞癌
E. 黏液表皮样瘤

正确答案：B。沃辛瘤

解析：本题考查唾液腺肿瘤。又名腺淋巴瘤的是沃辛瘤（B对）。沃辛瘤（Warthin tumor）又名腺淋巴瘤（adenolymphoma)或乳头状淋巴囊腺瘤，腺淋巴瘤的命名容易与恶性淋巴瘤相混淆，前者为良性肿瘤，后者则是恶性肿瘤。“乳头状淋巴囊腺瘤”是一个正确的病理性描述，但是较复杂，也容易与“乳头状囊腺瘤”相混淆。因此，在修订后的世界卫生组织组织学分类中，建议用“沃辛瘤”这一命名。混合瘤（多形性腺瘤）（A错）、腺样囊性癌（C错）、腺泡细胞癌（D错）、黏液表皮样瘤（E错）都不是腺淋巴瘤的别称。